肝胆疾病日久不愈，引发癥积或结石，其发病类型是
A. 伏而后发
B. 徐发
C. 继发
D. 合病
E. 并病

正确答案：C。继发

解析：继发，指在原发疾病未愈的基础上继而发生新的疾病（C对）；伏而后发，指感邪之后，邪藏体内，逾时而发的发病类型。这种发病形式多见于外感病和某些外伤病（A错）；徐发，徐缓而病的发病类型，多见于内伤邪气致病（B错）；合病，凡两经或三经的病证同时出现者（D错）；并病，若一经病证未罢又出现另一部位病证者（E错）。